P波与QRS波无固定关系，可见室性自主心律的心电图表现是
A. Ⅰ度房室传导阻滞
B. Ⅱ度Ⅱ型房室传导阻滞
C. Ⅱ度Ⅰ型房室传导阻滞
D. Ⅲ度房室传导阻滞
E. 窦房传导阻滞

正确答案：D。Ⅲ度房室传导阻滞

解析：Ⅲ度房室传导阻滞时，心电图表现为p波与QRS波无固定关系（D对）。Ⅰ度房室传导阻滞心电图表现为PR间期大于0.20秒（A错）。Ⅱ度Ⅱ型房室传导阻滞心电图可表现为P-R间期固定，QRS波有脱漏（B错）。Ⅱ度Ⅰ型房室传导阻滞心电图表现为PR间期延长，相邻R-R间期缩短，直至QRS波有脱漏（C错）。窦房传到阻滞根据心电图表现分为三个类型此选项太笼统（E错）。